患者，男性，35岁。左下第一磨牙拔除5个月，拟行种植义齿修复。该患者如有以下哪种疾病时，也可进行牙种植术
A. 耳、鼻、眼-眶内容及颅面缺损的颌面赝复体固位
B. 精神性疾病患者
C. 严重习惯性磨牙症
D. 颌骨内有良、恶性肿瘤
E. 严重糖尿病

正确答案：A。耳、鼻、眼-眶内容及颅面缺损的颌面赝复体固位

解析：耳、鼻、眼-眶内容及颅面缺损的颌面赝复体固位，是种植义齿的适应证，可进行种植修复。掌握“牙种植手术及效果评估”知识点。